以非转移性的高分化鳞癌的亚型，以外生性、疣状缓慢生长和边缘推压为特征的肿瘤为
A. 低分化鳞癌
B. 高分化鳞癌
C. 疣状癌
D. 微浸润性鳞状细胞癌
E. 中度分化鳞状细胞癌

正确答案：C。疣状癌

解析：本题考查口腔黏膜鳞癌及疣状癌。疣状癌（C对）为一种非转移性的高分化鳞癌的亚型，以外生性、疣状缓慢生长和边缘推压为特征。